治疗重症肌无力首选
A. 毛果芸香碱
B. 乙酰胆碱
C. 毒扁豆碱
D. 新斯的明
E. 肾上腺素

正确答案：D。新斯的明

解析：新斯的明具有抗胆碱酯酶作用，但对中枢神经系统的毒性较毒扁豆碱弱；因尚能直接作用于骨骼肌细胞的胆碱能受体，故对骨骼肌作用较强；缩瞳作用较弱。①诊断和治疗重症肌无力，增进并提高骨骼肌张力；②防治术后腹胀、麻痹性肠梗阻或膀胱收缩无力的尿潴留；③能拮抗非去极化肌松药作用。多用于重症肌无力及腹部手术后的肠麻痹。掌握“易逆性抗胆碱酯酶药”知识点。